幼儿急疹出疹时间是
A. 先出疹后退热
B. 退热后出疹
C. 边出疹边退热
D. 出疹1～2天后退热
E. 出疹3～5天后退热

正确答案：B。退热后出疹

解析：幼儿急疹（诸福棠实用儿科学P738）出疹时间一般是退热后出疹（B对）。幼儿急疹是婴幼儿常见的一种以高热、皮疹为特点的疾病，又发生于春秋季。典型的临床表现是发热1～5天，退热后出疹。